患者，6岁，因严重根尖周病拔除55，16萌出1/3；X线片显示15根发育1/2，应做何处理
A. 丝圈式保持器
B. 功能性活动保持器
C. 舌弓保持器
D. 远中导板保持器
E. 间隙扩展器

正确答案：D。远中导板保持器

解析：本题考查间隙保持器的适应证。患者，6岁，因严重根尖周病拔除55，16萌出1/3；X线片显示15根发育1/2，应进行的处理为远中导板保持器（D对）。远中导板式间隙保持器适于第二乳磨牙早失、第一恒磨牙尚未萌出或萌出中。用第一乳磨牙作基牙，戴入预成的或自制的合金全冠，冠的远中端焊接弯曲导板，插入牙槽窝内，远中导板贴合于未萌出的第一恒磨牙的近中面。丝圈式保持器（A错）适用于单侧第一乳磨牙早失；第一恒磨牙萌出后，单侧第二乳磨牙早失；双侧各有单颗乳磨牙早失，用其他间隙保持器装置困难的病例。功能性活动保持器（B错）适用于乳磨牙缺失两颗以上者，或两侧乳磨牙缺失，或伴有前牙缺失。舌弓保持器（C错）在两侧各有第二乳磨牙或第一恒磨牙为基牙时，适应证如下：1）乳尖牙早失。2）多颗乳磨牙早失，特别是近期有个别继承恒牙即将萌出仍需保持牙弓长度者。3）患儿不能合作配戴可摘式功能保持器。间隙扩展器（E错）多适用于间隙不足等，与本题干不符。